关节间隙由宽至窄的排序是
A. 上间隙、前间隙、后间隙
B. 上间隙、后间隙、前间隙
C. 前间隙、后间隙、上间隙
D. 前间隙、上间隙、后间隙
E. 后间隙、前间隙、上间隙

正确答案：B。上间隙、后间隙、前间隙

解析：本题考查X线平片检查。关节间隙由宽至窄的排序是上间隙、后间隙、前间隙（B对）。关节间隙为位于关节窝与髁突之间的低密度影像，主要为关节盘所占据。关节间隙2mm以上，上间隙最宽，后间隙次之，前间隙最窄，两侧对称。